成人内服冰片的一日量是
A. 0.15g～0.3g
B. 0.4g～0.6g
C. 0.7g～0.9g
D. 1g～1.2g
E. 1.5g～3g

正确答案：A。0.15g～0.3g

解析：本题考查的是片的用法用量。成人内服冰片的一日量是0.15g～0.3g（A对）。冰片：【用法用量】内服：入丸散，0.15g～0.3g，不入煎剂。外用：适量，研末干掺或调敷。